对于腹部手术后切口化脓性感染，错误的处理是
A. 应用抗菌药物
B. 切口内放置引流条
C. 局部理疗
D. 拆除缝线，敞开切口
E. 切开引流冲洗后立即缝合

正确答案：E。切开引流冲洗后立即缝合

解析：对于腰部手术后切口化脓性感染的患者，首先应及时拆除缝线，敞开切口（D对）引流脓液，接着用生理盐水反复冲洗，将脓液冲净。若伤后存在部分组织的坏死，应及时清除坏死组织，以避免感染的扩散及伤口的不愈合。伤口清洁完成后，应在切口内放置引流条（B对）以引流脓液及促使肉芽组织生长，而非切开引流冲洗后立即缝合（E错，为本题正确答案）。伤口处理完成后，应使用抗菌药物（A对）以限制感染的扩散，另外，还可局部理疗（C对）以促进感染伤口的愈合。